某男，59岁。近3年经常眩晕，头胀头痛，昨日突发口眼㖞斜，舌强，语言不利，半身不遂；舌红苔黄，脉弦。诊断为中风。四诊合参，辨析其证候是
A. 风阳上扰
B. 风痰入络
C. 阴虚风动
D. 血虚生风
E. 热极生风

正确答案：A。风阳上扰

解析：本题考查的是中风的辨证论治。某男，59岁。近3年经常眩晕，头胀头痛，昨日突发口眼㖞斜，舌强，语言不利，半身不遂；舌红苔黄，脉弦。诊断为中风。四诊合参，辨析其证候是风阳上扰（A对）。中风是以猝然昏仆，不省人事，半身不遂，口眼㖞斜，语言不利为主症的疾病。（一）风痰入络证（B错）：【症状】肌肤不仁，手足麻木，突然发生口眼斜，语言不利，口角流涎，舌强语謇，甚则半身不遂，或兼见手足拘挛，关节酸痛等症。舌苔薄白，脉浮数。（二）风阳上扰证：【症状】平素头晕头痛，耳鸣目眩，突然发生口眼斜，舌强语謇，或手足重滞，甚则半身不遂。舌质红苔黄，脉弦。（三）气虚血瘀证：【症状】肢体偏枯不用，肢软无力，面色萎黄。舌质淡紫或有瘀斑，苔薄白，脉细涩或细弱。血虚生风证（D错）：临床表现常见头目眩晕，视物模糊，面色萎黄，肢体麻木或震颤，手足拘急，肌肉瞤动，脉弦细，舌淡少苔。血虚筋脉失养所表现的动风，一般以筋脉、爪甲、两目、肌肤等失去血的濡养的症状，以及全身血虚为辨证要点。热极生风证（E错）：临床表现常见高热，肢体抽搐，项强，两眼上翻，甚则角弓反张，神志昏迷，舌红脉弦数。多以高热与肝风共见为辨证要点。